金铃子散主治
A. 肝郁气滞胁痛
B. 肝郁化火胁痛
C. 肝郁血虚胁痛
D. 肝郁阴虚胁痛
E. 肝胆实火胁痛

正确答案：B。肝郁化火胁痛

解析：金铃子散的功用为疏肝泄热，活血止痛，主治肝郁化火证。胸腹、胁肋（B对）、脘腹诸痛，或痛经、病气痛，时发时止，口苦，舌红苔黄，脉弦数。四逆散可治肝郁气滞胁痛（A错）。逍遥散可治肝郁血虚胁痛（C错）。一贯煎可治肝郁阴虚胁痛（D错）。龙胆泻肝汤主治肝胆实火胁痛（E错）。